远志的药理作用有
A. 抗菌
B. 祛痰
C. 抗惊厥
D. 保肝
E. 降血压

正确答案：A、B、C、E。抗菌；祛痰；抗惊厥；降血压

解析：本题考查远志的药理作用。远志的药理作用有抗菌（A对）、祛痰（B对）、抗惊厥（C对）、降血压（E对）。远志【药理作用】镇静、抗惊厥、改善睡眠、抗抑郁、增强学习记忆能力、祛痰、镇咳。穿心莲的药理作用穿心莲内酯为穿心莲抗炎作用的主要活性成分，临床已用于治疗急性菌痢、胃肠炎、咽喉炎、感冒发热等。穿心莲具有降血糖、保肝（D错）等作用。